具有体内外抗凝血作用的药物是
A. 肝素
B. 阿司匹林
C. 香豆素类
D. 链激酶
E. 右旋糖酐

正确答案：A。肝素

解析：肝素（A对）是凝血酶间接抑制药，属于抗凝血药，在体内、体外肝素均有强大抗凝作用，静脉注射后，抗凝作用立即发生。阿司匹林（B错）（P270）是环氧酶抑制剂，抑制花生四希酸转化为PGG2和PGH2，从而使血小板TXA2合成减少，是抗血小板药中应用最广泛的药物。香豆素类（C错）（P266）是维生素K拮抗剂，是体内抗凝剂。链激酶（D错）（P267）是纤维蛋白溶解药。右旋糖酐（E错）（P277）是葡萄糖的聚合物，是血容量扩张药。